某男，50岁。1月前，因工作问题而心情不舒，导致肝胃气滞，症见胁肋胃脘胀痛、嗳气。近10日来，又增梅核气，症见咽中如有物、咯之不出、咽之不下。宜选用的药是
A. 梅花
B. 红花
C. 菊花
D. 月季花
E. 玫瑰花

正确答案：A。梅花

解析：本题考查的是梅花的主治病证。1月前，因工作问题而心情不舒，导致肝胃气滞，症见胁肋胃脘胀痛、嗳气。近10日来，又增梅核气，症见咽中如有物、咯之不出、咽之不下。宜选用的药是梅花（A对）。梅花：【主治病证】（1）肝胃气滞之胁肋胃脘胀痛、嗳气。（2）梅核气。红花（B错）：【主治病证】（1）血滞闭经、痛经，产后恶露不尽。（2）胸痹心痛，癥瘕积聚，跌打肿痛。（3）斑疹色暗（配清热凉血解毒药）。菊花（C错）：【主治病证】（1）风热感冒，温病初起。（2）风热或肝火上攻所致的目赤肿痛。（3）肝阴虚之眼目昏花。（4）风热头痛，肝阳头痛、眩晕。（5）热毒疮肿。月季花（D错）：【主治病证】（1）月经不调，痛经，闭经。（2）肝郁之胸胁胀痛。玫瑰花（E错）：【主治病证】（1）肝胃气滞之胸胁脘腹胀痛。（2）肝郁血瘀之月经不调、乳房胀痛。（3）外伤肿痛。